成人内服麝香的一日量是
A. 0.03～0.1g
B. 0.1～0.3g
C. 0.3～0.6g
D. 0.6～1g
E. 1～3g

正确答案：A。0.03～0.1g

解析：本题考查的是麝香的用法用量。麝香【用法用量】内服：入丸散，0.03～0.1g（A对），不入煎剂。外用：适量，调敷或敷贴。